患者以胃脘痞塞，满闷不舒为主，按之柔软，压之不痛，望无胀形。发病缓慢，时轻时重，反复发作，病程漫长。多因饮食、情志、起居、寒温等因素诱发。其诊断是
A. 胃痛
B. 鼓胀
C. 痞满
D. 胸痹
E. 结胸

正确答案：C。痞满

解析：胃痛以上腹近心窝处胃脘部发生疼痛为特征，其疼痛有胀痛、刺痛、隐痛、剧痛等不同的性质。常伴食欲不振，恶心呕吐，嘈杂泛酸，嗳气吞腐等上消化道症状，多因天气变化、恼怒、劳累、暴饮暴食、饥饿、进食生冷干硬辛辣诱发，多有反复发作病史（A错）。鼓胀初起脘腹作胀，食后尤甚，继而腹部胀大如鼓，重者腹壁青筋显露，脐孔突起，常伴乏力、纳差、尿少及齿衄、鼻衄、皮肤紫斑等出血现象，常有酒食不节、情志内伤、虫毒感染或黄疸、胁痛、癥积等病史（B错）。痞满以胃脘痞塞，满闷不舒为主症，并有按之柔软，压之不痛，望无胀形的特点。发病缓慢，时轻时重，反复发作，病程漫长。多因饮食、情志、起居、寒温等因素诱发（C对）。胸痹以胸部闷痛为主症，患者多见膻中或心前区憋闷疼痛，常伴有心悸、气短、自汗，甚则喘息不得卧，常因操劳过度、抑郁恼怒、多饮暴食或气候变化而诱发（D错）。结胸是邪气结于胸中的病证，一类以胸胁部有触痛，头项强硬，发热有汗，为主症，一类以从心窝到少腹硬满而痛，拒按，大便秘结，口舌干燥而渴，午后稍有潮热为主症，常因太阳病、太少并病误下，表热内陷或实邪传里，与胸中水饮互结所致（E错）。